肺阴虚证的临床表现为
A. 咳嗽较重、干咳无痰，或痰少而黏
B. 咽喉干痒，或声音嘶哑
C. 身体消瘦
D. 舌红少津
E. 脉细无力

正确答案：A、B、C、D、E。咳嗽较重、干咳无痰，或痰少而黏；咽喉干痒，或声音嘶哑；身体消瘦；舌红少津；脉细无力

解析：本题考查的是肺阴虚证的临床表现。肺阴虚证的临床表现为咳嗽较重、干咳无痰，或痰少而黏（A对）、咽喉干痒，或声音嘶哑（B对）、身体消瘦（C对）、舌红少津（D对）与脉细无力（E对）。肺阴虚证的临床表现，常见咳嗽较重，干咳无痰，或痰少而黏，并有咽喉干痒，或声音嘶哑，身体消瘦，舌红少津，脉细无力。阴虚火旺还可见咳痰带血，干渴思饮，午后发热，盗汗，两颧发红，舌质红，脉细数。